胆管细胞癌
A. AFP＜21μg/L
B. AFP＞100μg/L
C. AFP＞200μg/L持续6周
D. AFP＞200μg/L持续8周
E. AFP＞500μg/L持续2周

正确答案：A。AFP＜21μg/L

解析：甲胎蛋白是在胎儿早期由肝脏和卵黄囊合成的一种血清糖蛋白，出生后，AFP的合成很快受到抑制。当肝细胞或生殖腺胚胎组织发生恶性病变时，有关基因重新被激活，使原来丧失合成AFP的细胞又重新开始合成，以致血中AFP含量明显升高。胆管细胞癌，癌细胞由胆管上皮细胞发展而来，与合成AFP的肝细胞无关，因而甲胎蛋白不会增高。正常人血清中可测出微量AFP，正常值小于25μg/L（A对）。